治疗腰部冷痛重着，拘挛不可仰，舌淡，苔白，脉紧，除阿是穴、大肠俞、委中外，应选取
A. 膈俞
B. 腰阳关
C. 足三里
D. 志室
E. 悬钟

正确答案：B。腰阳关

解析：题干中出现腰部冷痛重着，拘挛不可仰，舌淡，苔白，脉紧的症状为寒湿腰痛的表现，应加腰阳关，此穴位对于治疗腰部怕冷症非常显效（B对）。瘀血腰痛加膈腧（A错）。足三里主治：胃痛、呕吐、腹胀、肠鸣、消化不良、下肢痿痹、泄泻、便秘、痢疾、疳积、癫狂、中风、脚气、水肿、下肢不遂、心悸、气短、虚劳赢瘦，不是治疗腰痛的常用穴位（C错）。志室治疗膀胱经腰痛（D错）。悬钟主治痴呆、中风等髓海不足疾患；颈项强痛，胸胁满痛，下肢痿痹，无治疗腰痛的作用（E错）。